丙米嗪（米帕明）抗抑郁症的机制是
A. 促进脑内NA和5-HT释放
B. 抑制脑内NA和5-HT释放
C. 促进脑内NA和5-HT再摄取
D. 抑制脑内NA和5-HT再摄取
E. 激活脑内D₂受体

正确答案：D。抑制脑内NA和5-HT再摄取